自牙槽嵴向牙冠方向展开，穿过固有层止于游离龈和附着龈的是
A. 龈牙组
B. 牙槽龈组
C. 环形组
D. 牙骨膜组
E. 越隔组

正确答案：B。牙槽龈组

解析：牙槽龈组，自牙槽嵴向牙冠方向展开，穿过固有层止于游离龈和附着龈的固有层中。掌握“牙龈”知识点。